患者女65岁，近日突发呼吸困难，肺部充满湿啰音，咳粉红色泡沫痰，既往冠心病史10年，R35次/分，BP80/50mmHg，心率102次/分，S3奔马律。该患者不应选择的药物是
A. 多巴胺
B. 异丙肾上腺素
C. 去甲肾上腺素
D. 氨茶碱
E. 硝普钠

正确答案：E。硝普钠

解析：患者突发呼吸困难，咳粉红色泡沫痰（急性左心衰竭的特征性表现），R35次/分，BP80/50mmHg，肺部充满湿啰音，心率102次/分，S3奔马律，诊断宜首先考虑急性左心衰竭。患者目前血压降低（正常血压90-140/60-90mmHg），硝普钠（E错，为本题正确答案）为动静脉血管扩张剂，会加重血压进一步下降。多巴胺（A对）为β受体兴奋剂，可增加肾血流量，增加心肌收缩力和心输出量。异丙肾上腺素（B对）、去甲肾上腺素（C对）为血管收缩剂，用于正性肌力药无明显改善的心源性休克。氨茶碱（D对）解除支气管痉挛，并有一定的增强心肌收缩、扩张外周血管作用。